下列各项，不属医院感染的是
A. 无明显潜伏期的感染，在入院48小时后发生的感染
B. 本次感染直接与上次住院有关
C. 有明确潜伏期的感染，自入院时算起没有超过其平均潜伏期的感染
D. 新生儿经产道时获得的感染
E. 肿瘤患者住院化疗期间出现带状疱疹

正确答案：C。有明确潜伏期的感染，自入院时算起没有超过其平均潜伏期的感染

解析：下列情况均可诊断为医院感染：1.患者在入院时无感染，在入院后发生感染，包括在院内感染出院后发病者。2.自人院时起超过平均潜伏期之后发生的感染。3.无潜伏期疾病，入院48小时后发生的感染（A对）。4.本次感染直接与上次住院有关（B对）。5.在原有感染基础上出现其他部位新的感染（除外脓毒血症迁徙灶），或在原感染已知病原体基础上又分离出新的病原体（排除污染和原来的混合感染）的感染。6.新生儿经产道时获得的感染（D对）。7.由于诊疗措施激活的潜在性感染，如疱疹病毒、结核杆菌等的感染（E对）。8.医务人员在医院内获得的感染（C错，为本题正确答案）。